哪项不是引起血液性缺氧的原因
A. CO中毒
B. 血红蛋白病，氧不易释出
C. 贫血
D. 静脉血栓形成
E. 肠源性紫绀

正确答案：D。静脉血栓形成

解析：由于血红蛋白含量减少，或血红蛋白性质改变，使血液携氧能力下降或与血红蛋白结合的氧不易释放引起的缺氧，称为血液性缺氧。引起其缺氧的原因有：①血红蛋白含量减少，主要见于各种原因引起的严重贫血（C对）。②一氧化碳中毒（A对）。③高铁血红蛋白血症，如肠源性紫绀（E对）。④血红蛋白与氧的亲和力异常增高（如血红蛋白病），从而使组织缺氧（B对）。静脉血栓形成（D错，为本题正确答案）是引起循环性缺氧的原因。